清音丸除清热利咽外，又能
A. 生津润燥
B. 凉血解毒
C. 化痰散结
D. 化腐止痛
E. 祛腐生肌

正确答案：A。生津润燥

解析：本题考查的是清音丸的功能。清音丸除清热利咽外，又能生津润燥（A对）。清音丸：【功能】清热利咽，生津润燥。栀子金花丸：【功能】清热泻火，凉血解毒（B错）。黄氏响声丸：【功能】疏风清热，化痰散结（C错），利咽开音。六神丸：【功能】清热解毒，消肿利咽，化腐止痛（D错）。珠黄散：【功能】清热解毒，祛腐生肌（E错）。